体内某些胺类在生长旺盛组织（胚胎、肿瘤）中含量较高，它是调节细胞生长的重要物质，该胺是
A. 牛磺酸
B. 多胺
C. 组胺
D. γ氨基丁酸
E. 5-羟色胺

正确答案：B。多胺